多巴胺最适用于治疗的是
A. 伴有心肌收缩力减弱，尿量减少而血容量已补足的休克病人
B. 青霉素G引起的过敏性休克
C. 心源性哮喘
D. 支气管哮喘
E. 缓慢性心律失常

正确答案：A。伴有心肌收缩力减弱，尿量减少而血容量已补足的休克病人

解析：多巴胺主要用于治疗各种休克，如心源性休克、感染性休克和出血性休克等，尤其适用于伴有心肌收缩力减弱、尿量减少而血容量已补足的休克。此外，还可与利尿药等合用治疗急性肾功能衰竭（A对）。